能引起肝癌的是
A. 联苯胺
B. 氯甲醚
C. 砷
D. 氯乙烯
E. 铬酸盐

正确答案：D。氯乙烯

解析：本题考查氯乙烯的致肝癌作用。当机体长时间接触氯乙烯（D对ABCE错）时，会导致肝癌发生率大大提高，主要会导致肝血管肉瘤，多见于接触高浓度氯乙烯的清釜工，潜伏期长。